贝尔面瘫与中枢性面瘫相鉴别的重要临床表现是
A. 眼睑闭合不全
B. 额纹消失，不能皱眉
C. 口角偏斜
D. 鼓腮不能
E. 鼻唇沟消失

正确答案：B。额纹消失，不能皱眉

解析：贝尔面瘫为周围性面神经麻痹，其表现为病变侧前额纹消失，不能蹙眉。而中枢性面神经麻痹的表现为病变对侧睑裂以下的颜面部表情肌瘫痪。掌握“面神经麻痹”知识点。